我国居民膳食宝塔第一层是
A. 粮谷类
B. 蔬菜、水果类
C. 豆类及其制品
D. 油脂
E. 动物性食品

正确答案：A。粮谷类